男性，58岁。反复咳嗽咳痰15年，心悸气急3年。体检：双肺叩诊呈过清音，呼吸音减弱，肺底部有湿啰音，剑突下心尖搏动明显，该处可闻及3/6级收缩期杂音，肺动脉瓣区第二音亢进。该例最可能的诊断为
A. 慢性支气管炎（慢支）
B. 慢支+肺气肿
C. 慢支+肺气肿+肺心病
D. 慢支+风湿性心瓣膜病
E. 慢支+冠心病

正确答案：C。慢支+肺气肿+肺心病

解析：患者为老年男性，有长期的反复咳嗽咳痰病史（为慢性支气管炎的典型表现），考虑首先诊断为慢性支气管炎，患者有双肺叩诊呈过清音（为慢阻肺的典型表现），呼吸音减弱，考虑慢性支气管炎并发了肺气肿，剑突下心尖搏动明显，该处可闻及3/6级收缩期杂音，肺动脉瓣区第二音亢进，考虑发生了肺源性心脏病（该患者符合肺源性心脏病的典型临床表现和体征），根据其临床表现和体征，故最可能的诊断为慢支+肺气肿+肺心病（C对AB错）。该患者没有患风湿的病史，故不考虑为风湿性心瓣膜病（D错）。冠心病（P219）（E错）的典型症状为阵发性胸前区疼痛或憋闷，休息或服用硝酸甘油后疼痛消失，与本患者症状不符，故不考虑。